患者咳铁锈色痰，可见于
A. 支气管扩张
B. 肺炎球菌肺炎
C. 肺结核
D. 慢阻肺
E. 双肺闻及哮鸣音

正确答案：B。肺炎球菌肺炎

解析：肺炎链球菌肺炎主要症状为发热、胸痛、咯铁锈色痰（B对）。支气管扩张临床表现主要为：慢性咳嗽、咳大量脓痰和（或）反复咯血，多见于儿童和青年（A错）。肺结核多呈慢性过程，以低热、盗汗、消瘦、乏力、食欲不振等全身中毒症状及咳嗽、咳痰黏液痰或浓痰、咯血、呼吸困难、胸痛等呼吸系统症状为主要表现（C错）。慢阻肺主要临床表现为慢性咳嗽、咳痰一般为白色黏液或浆液性泡沫样痰，偶可带血丝，清晨排痰较多。急性发作期痰量增多，可有脓性痰。气短、喘息或呼吸困难等（D错）。